年轻恒牙全脱出多发生于
A. 上颌中切牙
B. 上颌侧切牙
C. 上颌尖牙
D. 下颌中切牙
E. 下颌侧切牙

正确答案：A。上颌中切牙

解析：本题考查年轻恒牙外伤。年轻恒牙全脱出：常见于单个年轻恒牙，上颌中切牙（A对）多发。牙齿全脱位时应该立即进行再植术。